属于继发性免疫缺陷病的是
A. X连锁低丙球蛋白血症
B. DiGeorge综合征
C. 慢性肉芽肿瘤
D. AIDS
E. 白细胞黏附缺陷

正确答案：D。AIDS